胸导管叙述错误的是
A. 淋巴管道组成部分
B. 经内踝后方
C. 全身最大的淋巴导管
D. 穿主动脉裂孔进人胸腔
E. 注入左静脉角

正确答案：B。经内踝后方

解析：胸导管是全身最大的淋巴导管（C对），属于淋巴管道组成部分（A对），起自乳糜池，穿主动脉裂孔进入胸腔（D对），而后在主动脉和奇静脉之间上行，至第5胸椎高度经食管和和脊柱之间向左斜行，沿着脊柱左上方上行至胸廓至颈部，在左颈总动脉和左颈内静脉后方转向前内下方注入左静脉角（E对），并未有经过内踝前方（B错，为本题正确答案）。